颌骨囊肿的囊壁无角化，无上皮钉突，类似于缩余釉上皮，纤维囊壁内炎症不明显，属于哪种疾病的病理表现
A. 鼻腭管囊肿
B. 黏液囊肿
C. 含牙囊肿
D. 根尖囊肿
E. 多形性腺瘤

正确答案：C。含牙囊肿

解析：含牙囊肿又称滤泡囊肿，肉眼见囊壁较薄，囊腔内含有牙冠，囊壁附着于牙颈部，囊液多呈黄色；镜下见纤维结缔组织囊壁内衬较薄的复层扁平上皮，无角化，无上皮钉突，类似于缩余釉上皮；纤维囊壁内炎症不明显。掌握“牙源性囊肿”知识点。